患者感受暑湿,症见身热烦渴，小便不利。治疗应首选
A. 六一散
B. 猪苓汤
C. 泻白散
D. 五苓散
E. 二妙散

正确答案：A。六一散

解析：“患者感受暑湿,症见身热烦渴，小便不利”是六一散主治的临床表现。六一散主治暑湿证。身热烦渴，小便不利，或泄泻（A对）。记忆：六一散用滑石草，清暑利湿有功效。